尿道膜部
A. 是男性尿道三部中最狭窄，最短，最固定的一段
B. 周围环绕着由平滑肌组成的尿道膜部括约肌
C. 两侧有尿道球腺，其排泄管开口于此部
D. 周围有尿道外括约肌环绕，该肌有控制排尿的作用
E. 上述全部正确

正确答案：D。周围有尿道外括约肌环绕，该肌有控制排尿的作用

解析：周围环绕着由横纹肌（B错）组成的尿道外括约肌。尿道有三个狭窄：尿道内口，尿道膜部，尿道外口，外口最窄，呈矢状裂隙（A错，D对）